女，32岁。停经56天，行人工流产负压吸宫术时突然出现面色苍白，大汗淋漓，查：BP：70/50mmHg，P：60次/分。最有可能的诊断是
A. 子宫穿孔
B. 羊水栓塞
C. 空气栓塞
D. 人工流产综合征
E. 漏吸

正确答案：D。人工流产综合征

解析：该患者为育龄期妇女，停经56天，在人工流产负压吸宫术时突然出现面色苍白，大汗淋漓，低血压，心动过缓（人工流产综合反应是指手术时疼痛或局部刺激，使受术者在术中或术毕出现恶心呕吐、心动过缓、心律不齐、面色苍白、头昏、胸闷、大汗淋漓，严重者甚至出现血压下降、昏厥、抽搐等迷走神经兴奋症状），最可能的诊断是人工流产综合征（D对）。子宫穿孔（P383）（A错）表现为手术时突然感到无宫底感觉，或手术器械进入深度超过原来所测得深度。羊水栓塞（P384）（B错）在人工流产术少见，往往由于宫颈损伤、胎盘剥离使血窦开放，为羊水进入创造条件，即使并发羊水栓塞，其症状及严重性不如晚期妊娠发病凶猛；空气栓塞（C错）不是人工流产的并发症。漏吸（P384）（E错）是指施行人工流产术未吸出胚胎及绒毛而导致继续妊娠或胚胎停止发育。